牙体缺损修复体的模型灌制应该用
A. 硬石膏
B. 软石膏
C. 生石膏
D. 石膏粉
E. 石膏山

正确答案：A。硬石膏

解析：本题考查暂时冠及印模与模型。制作牙体缺损修复体的模型应该用超硬石膏（A对）灌制。制作修复体之前，需将模型做成可卸代型，目的是确保制作出的修复体边缘与工作模型预备体的颈缘完全吻合，与预备体密合，与邻牙有良好的接触关系。